苷的分类，苦杏仁苷属于
A. 氰苷
B. 酯苷
C. 碳苷
D. 酚苷
E. 硫苷

正确答案：A。氰苷

解析：本题考查的是为苷的分类。苷的分类，苦杏仁苷属于氰苷（A对）。依据苷键原子的不同可将苷分为O-苷、S-苷、N-苷和C-苷。1.氧苷（O-苷）：以苷元不同，又可分为醇苷、酚苷、氰苷、酯苷和吲哚苷。（1）醇苷：如红景天苷、毛茛苷、獐牙菜苷。（2）酚苷（D错）：如天麻苷、水杨苷。（3）氰苷：如苦杏仁苷。（4）酯苷（B错）：如山慈菇苷A等。（5）吲哚苷：如靛苷。2.硫苷（E错）（S-苷）：如萝卜苷、芥子苷。3.氮苷（N-苷）：如核苷类物质腺苷、鸟苷、胞苷和尿苷，中药巴豆中的巴豆苷。4.碳苷（C错）（C-苷）：如牡荆素、芦荟苷